山茱萸具有的功效是
A. 补益肝肾，敛疮
B. 收敛固涩，止咳
C. 收敛固涩，止血
D. 补益肝肾，润肺
E. 补肾涩精，止泻

正确答案：C。收敛固涩，止血

解析：该题考查山茱萸的功效主治，属记忆内容。山茱萸味酸、涩，性微温；入肝、肾经；入于下焦，能补肝肾、固冲任以止血（C对ABDE错）。